易阻碍受精卵着床导致不孕的是
A. 浆膜下肌瘤
B. 肌壁间肌瘤
C. 阔韧带肌瘤
D. 粘膜下肌瘤
E. 宫颈肌瘤

正确答案：D。粘膜下肌瘤

解析：肌瘤对妊娠及分娩的影响与肌瘤的类型及大小有关。黏膜下肌瘤（D对）可影响受精卵着床，导致早期流产；肌壁间肌瘤（B错）过大可使宫腔变形或内膜供血不足引起流产，或胎儿娩出后因胎盘附着面大或子宫收缩不良导致产后出血。过大的子宫下段或宫颈肌瘤（E错）可导致产道梗阻。浆膜下肌瘤（A错）和阔韧带肌瘤（C错）瘤体向子宫浆膜面生长，仅有一蒂与子宫相连，不会对宫腔造成压迫故一般不会影响妊娠。